中年男性患者，近两周来出现头晕乏力，鼻腔出血等症，查体：颈部浅表淋巴结肿大，下肢少许瘀斑。白细胞16.6×109/L，原始细胞0.60，血红蛋白80g/L，血小板34×109/L。最可能的诊断是
A. 急性白血病
B. 缺铁性贫血
C. 再生障碍性贫血
D. 溶血性贫血
E. 特发性血小板减少性紫癜

正确答案：A。急性白血病

解析：该患者急性发病，白细胞增多，原始细胞增加，应考虑急性白血病。其他选项均无白细胞增高。掌握“急性白血病”知识点。